下列哪项不是龈上洁治术的去除对象
A. 龈上牙石和浅的龈下牙石
B. 龈上菌斑
C. 色渍
D. 龈下菌斑
E. 磨光牙面

正确答案：D。龈下菌斑

解析：本题考查龈上洁治术的去除对象。龈下菌斑不能用于龈上洁治去除，应用比较精细的龈下刮治器刮除位于牙周袋内根面上的牙石和菌斑（D错，为本题的正确答案）。洁治术是所有牙周治疗的第一步，通过洁治术，绝大多数慢性龈缘炎可以治愈，龈上洁治术是指用洁治器去除龈上牙石（A对）、菌斑（B对）和色渍（C对）并磨光牙面（D对）,而牙周炎是在洁治术的基础上再作龈下刮治术及其他治疗的。